女婴，4个月。烦躁、多汗半个月，夜间哭闹不安。冬季出生，足月顺产，单纯牛奶喂养，未添加辅食。查体：体重6kg，有颅骨软化。最可能的诊断是
A. 维生素A缺乏症
B. 维生素D缺乏性佝偻病
C. 蛋白质-能量营养不良
D. 维生素D缺乏性手足搐搦症
E. 缺铁性贫血

正确答案：B。维生素D缺乏性佝偻病

解析：6月龄患儿，有典型症状：颅骨软化，另外还有有烦躁、多汗、夜间哭闹不安的非特异性表现，应诊断为维生素D缺乏性佝偻病（B对）。虽然维生素D缺乏性手足搐溺症会有维生素D缺乏性佝偻病的病史，但此病的典型表现是惊厥、喉痉挛和手足搐搦，与该患儿的临床症状不符（D错）。维生素A缺乏表现为经典的皮肤角化过度和眼干燥症（A错）。蛋白质-能量营养不良一般有体重下降，而该患儿6个月，体重是6kg，体重正常，故不能诊断为蛋白质-能量营养不良（C错）。缺铁性贫血的一般表现皮肤黏膜逐渐苍白，以唇、口腔黏膜及甲床较明显，易疲乏，不爱活动（E错）。